成釉器可以形成
A. 牙周膜
B. 牙骨质
C. 牙槽骨
D. 牙釉质
E. 牙本质

正确答案：D。牙釉质

解析：牙胚由牙板及邻近的外胚间叶组织发育而来，牙板的发生是牙齿发育的开始。牙胚由成釉器、牙乳头和牙囊构成。牙胚将形成4种牙体组织和部分牙周组织，其中成釉器形成釉质，牙乳头形成牙本质和牙髓，牙囊形成牙骨质、牙周膜和部分牙槽骨。掌握“牙胚的发生及分化”知识点。